下列关于毛果芸香碱调痉挛作用除外的是
A. 环状肌向瞳孔中心方向收缩
B. 悬韧带放松
C. 晶状体变凸
D. 屈光度增加
E. 难以看清近物

正确答案：E。难以看清近物

解析：本题考查毛果芸香碱。调节痉挛：毛果芸香碱滴眼后，环状肌向瞳孔中心方向收缩（A对），造成悬韧带放松（B对），晶状体由于本身弹性变凸（C对），屈光度增加（D对），此时只适合于视近物，而难以看清远物（E错，为本题正确答案），毛果芸香碱的这种作用称为调节痉挛。